可用双缩脲反应鉴别的药物是
A. 地西泮
B. 黄体酮
C. 维生素B₁
D. 维生素C
E. 盐酸麻黄碱

正确答案：E。盐酸麻黄碱

解析：本题考查苯乙胺类拟肾上腺素药物的分析。盐酸麻黄碱（E对）、盐酸伪麻黄碱和盐酸去氧肾上腺素等药物分子结构中，芳环侧链具有氨基醇结构，可显双缩脲特征反应。